在人类致病菌中最粗大的杆菌是
A. 放线菌
B. 炭疽芽胞杆菌
C. 麻风分支杆菌
D. 白喉棒状菌属
E. 结核分支杆菌

正确答案：B。炭疽芽胞杆菌

解析：炭疽芽胞杆菌是致病菌中最粗大的杆菌，（1～3）μm×（5～10）μm。掌握“动物源性细菌”知识点。